来源于百合科植物根状茎的药材是
A. 香附
B. 玉竹
C. 浙贝母
D. 射干
E. 天冬

正确答案：B。玉竹

解析：本题考查的是玉竹的来源。来源于百合科植物根状茎的药材是玉竹（B对）。玉竹【来源】为百合科植物玉竹的干燥根茎。香附（A错）【来源】为莎草科植物莎草的干燥根茎。浙贝母（C错）【来源】为百合科植物浙贝母的干燥鳞茎。射干（D错）【来源】为鸢尾科植物射干的干燥根茎。天冬（E错）【来源】为百合科植物天冬的干燥块根。